独语、错语的共同病因是
A. 风痰阻络
B. 热扰心神
C. 心气大伤
D. 心气不足
E. 痰火扰心

正确答案：D。心气不足

解析：独语，多因心气虚弱，神气不足，或气郁痰阻，蒙蔽心神所致。错语，虚证多因心气虚弱，神气不足所致；实证多因痰湿、瘀血、气滞阻碍心窍所致。故独语、错语的共同病因是心气不足（D对）。语言謇涩，多因风痰蒙蔽清窍或风痰阻络所致（A错）。谵语，多因热扰心神之实证所致（B错）。郑声，多因心气大伤，精神散乱之虚证所致（C错）。狂证，多因痰火扰心或伤寒蓄血所致（E错）。